克雷伯杆菌肺炎的X线表现出现叶间隙下坠，其原因是
A. 细菌在细胞内生长繁殖，引起组织坏死液化形成
B. 病变中的炎性渗出液粘稠而重
C. 肺泡内的渗出液由Cohn氏孔向周围肺泡蔓延所致
D. 肺泡内的纤维蛋白渗出较多
E. 肺泡内的渗出含有较多的红白细胞

正确答案：B。病变中的炎性渗出液粘稠而重

解析：肺炎克雷伯杆菌常存在于人体上呼吸道及肠道，当机体抵抗力降低时，经呼吸道进入肺内引起大叶或者小叶融合性病变，以上叶为多见，病灶中渗出液黏稠而重（B对），致使叶间隙下坠。肺泡内的渗出液由Cohn氏孔向周围肺泡蔓延所致（C错）、肺泡内的纤维蛋白渗出较多（D错）、肺泡内的渗出含有较多的红白细胞（E错）均为肺炎链球菌肺炎的病理变化。细菌在细胞内生长繁殖，引起组织坏死液化形成（A错）为葡萄球菌肺炎的病理变化。